某患者，受冷风吹面后，次日晨起发现口角流涎。检查：一侧眼裂较大，不能皱额，鼻唇沟变浅，口角下垂。应首先考虑的是
A. 蛛网膜下腔出血
B. 脑瘤
C. 脑梗死
D. 脑出血
E. 周围性面神经麻痹

正确答案：E。周围性面神经麻痹

解析：该患者受冷风吹面后（受寒可引起局部神经营养血管痉挛，导致面神经缺血水肿并受到压迫），次日晨起发现口角流涎，检查发现一侧眼裂较大，不能皱额，鼻唇沟变浅，口角下垂（这是面神经麻痹所致；一侧眼裂较大，不能皱额，鼻唇沟变浅，口角下垂提示周围性(核或核下性)损害），综合患者病史及检查应首先考虑的是周围性面神经麻痹（E对）。蛛网膜下腔出血（八版外科学P220）（A错）的患者多有颅内动脉瘤和脑（脊髓）血管畸形，主要临床表现为突发剧烈头痛、恶心呕吐、脑膜刺激征阳性、偏瘫等，不会因为受凉而引起相应症状。脑瘤（B错）因位置和病理性质不同，会出现不同临床表现，可有头晕头痛、呕吐、复视、视力障碍、隐袭起病、进行性加重的病程特点，缓慢起病，该例病程较短故排除。脑梗死（C错）的病因基础是动脉粥样硬化，患者常伴有高血压、糖尿病、高血脂等高危因素，起病急，多在休息或睡眠中发病，可出现肢体偏瘫，多不引起面神经麻痹症状。脑出血（D错）主要与脑血管病变有关，与高血压、糖尿病、高血脂、吸烟等密切相关，患者多由于情绪激动、费劲用力时突然发病，基底核、丘脑和内囊出血引起的轻偏瘫是常见的早期症状，与该例病史不符故排除。